根据《疫苗流通和预防接种管理条例》疾病预防控制机构，疫苗生产企业应对运输过程中的疫苗进行温度监测并记录。其记录内容除疫苗名称，生产企业，供货（发送）单位，数量，批号及有效期外，还应包括
A. 疫苗运输过程中的温度变化
B. 启运和到达时的疫苗储存温度和环境温度
C. 疫苗运输工具和接送人签字
D. 疫苗启运和到达时间

正确答案：A、B、C、D。疫苗运输过程中的温度变化；启运和到达时的疫苗储存温度和环境温度；疫苗运输工具和接送人签字；疫苗启运和到达时间

解析：本题考查疫苗全程冷链储运管理制度。根据《疫苗流通和预防接种管理条例》疾病预防控制机构，疫苗生产企业应对运输过程中的疫苗进行温度监测并记录。其记录内容除疫苗名称，生产企业，供货（发送）单位，数量，批号及有效期外，还应包括疫苗运输过程中的温度变化（A对）、启运和到达时的疫苗储存温度和环境温度（B对）、疫苗运输工具和接送人签字（C对）、疫苗启运和到达时间（D对）。疫苗配送企业、疾病预防控制机构、接种单位应对疫苗运输过程进行温度监测，填写“疫苗运输温度记录表”，记录内容包括疫苗运输工具、疫苗冷藏方式、疫苗名称、生产企业、规格、批号、有效期、数量、用途、启运和到达时间、启运和到达时的疫苗储存温度和环境温度、启运至到达行驶里程、送/收疫苗单位、送/收疫苗人签名。运输时间超过6小时，须记录途中温度。途中温度记录时间间隔不超过6小时。